关于管型的叙述，正确的是
A. 红细胞管型，常见于肾盂肾炎
B. 白细胞管型，常见于急性肾炎
C. 脂肪管型，常见于急性肾衰竭
D. 蜡样管型，常见于慢性肾炎晚期
E. 粗大上皮细胞管型，常见于肾病综合征

正确答案：D。蜡样管型，常见于慢性肾炎晚期

解析：蜡样管型是由颗粒管型、细胞管型在肾小管中长期停留变形或直接由淀粉样变性的上皮细胞溶解后形成，该管型多提示有严重的肾小管变性坏死，预后不良，见于慢性肾炎晚期（D对）。红细胞管型见于泌尿系统炎症、结石、肿瘤、结核、外伤等（A错）。白细胞管型见于肾盂肾炎、间质性肾炎（B错）。脂肪管型见于肾病综合征、慢性肾小球肾炎急性发作及其他肾小管损伤性疾病（C错）。粗大上皮细胞管型见于慢性肾衰竭少尿期（E错）。